“阳脉之海”指的是
A. 阳跷脉
B. 阳维脉
C. 带脉
D. 督脉
E. 冲脉

正确答案：D。督脉

解析：阳跷脉调节肢体运动，司眼睑开合，阳维脉调节六阳经经气，二者都无“阳脉之海”之称（AB错）；带脉约束纵行躯干的诸条经脉，也无“阳脉之海”之称（C错）；督脉、任脉、冲脉皆起于胞中，同出于会阴，而分别循行于人体的前后正中线和腹部两侧，故称为“一源三歧”。督脉总督六阳经，调节全身阳经经气，督脉走行背部，背为阳故称“阳脉之海”(D对)，任脉总任六阴经，调节全身阴经经气，任脉走行胸腹，胸腹为阴，故称“阴脉之海”，冲脉涵蓄十二经气血，故称“十二经之海”，又称“血海”（E错）。对于奇经八脉的功能及特殊称谓要熟练记忆。